下列关于流行性乙型脑炎的病理改变的叙述，错误的是
A. 神经细胞变性，坏死
B. 血管套形成
C. 软化灶
D. 蛛网膜下腔有脓性渗出物
E. 胶质细胞增生

正确答案：D。蛛网膜下腔有脓性渗出物

解析：流行性乙型脑炎是由乙型脑炎病毒感染引起的急性传染病，其基本病变有：血管周围淋巴细胞浸润和血管套形成（B对），神经细胞变性坏死（A对），软化灶形成（C对）和胶质细胞增生（E对）。流行性乙型脑炎由病毒感染引起，无脓性物渗出（D错，为本题正确答案），蛛网膜下腔有脓性渗出物主要见于流行性脑脊髓膜炎。